口服缓控释制剂的特点不包括
A. 可减少给药次数
B. 可提高病人的服药顺应性
C. 可避免或减少血药浓度的峰谷现象
D. 有利于降低肝首过效应
E. 有利于降低药物的毒副作用

正确答案：D。有利于降低肝首过效应

解析：本题考查口服缓控释制剂的特点。口服缓控释制剂的特点不包括有利于降低肝脏的首过效应（D错，为本题正确答案）。缓控释制剂的特点：（1）减少给药次数（A对），提高患者的用药顺应性（B对）；（2）血药浓度平稳，减少峰谷现象（C对），有利于降低药物的毒副作用（E对）；（3）缓释、控释制剂种类多样，其中口服药物仍有首过效应。